合并用药的四个原则是
A. 相加
B. 相除
C. 相乘
D. 协同
E. 拮抗

正确答案：A、C、D、E。相加；相乘；协同；拮抗